下列哪一项不是瘀血的致病特点
A. 易于阻滞气机
B. 影响血脉运行
C. 影响水液代谢
D. 病位固定
E. 影响新血生成

正确答案：C。影响水液代谢

解析：瘀血的致病特点主要表现在：1.易于阻滞气机（A对）2.影响血脉运行（B对）3.影响新血生成（E对）4.病位固定，病证繁多（D对）（C错，为本题正确答案）。